非经胃肠道给药的剂型包括
A. 糊剂
B. 舌下片剂
C. 气雾剂
D. 贴剂
E. 肠溶胶囊剂

正确答案：A、B、C、D。糊剂；舌下片剂；气雾剂；贴剂

解析：本题考查非经胃肠道给药的剂型。非经胃肠道给药的剂型包括糊剂（A对）、舌下片剂（B对）、气雾剂（C对）、贴剂（D对）。非经胃肠道给药剂型是指除胃肠道给药途径以外的其它所有剂型，包括：①注射给药：如注射剂，包括静脉注射、肌内注射、皮下注射及皮内注射等；；②皮肤给药：如如外用溶液剂、洗剂、软膏剂、贴剂、凝胶剂等；③口腔给药：如漱口剂、含片、舌下片剂、膜剂等；④鼻腔给药：如滴鼻剂、喷雾剂、粉雾剂等；⑤肺部给药：如气雾剂、吸入制剂、粉雾剂等；⑥眼部给药：如滴眼剂、眼膏剂、眼用凝胶、植入剂等；⑦直肠、阴道和尿道给药：如灌肠剂、栓剂等。经胃肠道给药剂型是指给药后药物经胃肠道吸收后发挥疗效，如溶液剂、糖浆剂、颗粒剂、胶囊剂、散剂、丸剂、片剂等。肠溶胶囊剂属于经胃肠道给药的剂型（E错）。